他汀类药物可引起腹痛或横纹肌溶解症的不良反应，因该不良反应而撤出市场的药物是
A. 辛伐他汀
B. 氟伐他汀
C. 普伐他汀
D. 西立伐他汀
E. 阿托伐他汀

正确答案：D。西立伐他汀

解析：本题考查他汀类药物的不良反应。西立伐他汀（D对）由于引起横纹肌溶解，导致病人死亡的副作用而撤出市场。辛伐他汀（A错）用于治疗高胆固醇血症和混合型高脂血症，也可用于冠心病和缺血性脑卒中的防治。氟伐他汀（B错）用于原发性高胆固醇血症，原发性混合型血脂异常。普伐他汀（C错）用于治疗高脂血症、家族性高胆固醇血症。阿托伐他汀（E错）用于高胆固醇血症，冠心病和脑卒中的防治。